长期应用易使血钾升高的药物
A. 呋塞米
B. 布美他尼（丁苯氧酸）
C. 依他尼酸（利尿酸）
D. 螺内酯
E. 氢氯噻嗪

正确答案：D。螺内酯